下列哪种病变愈合后会形成瘢痕
A. 寻常型天疱疮
B. 大疱性类天疱疮
C. 瘢痕性类天疱疮
D. 多形性类天疱疮
E. B+C

正确答案：C。瘢痕性类天疱疮

解析：本题考查类天疱疮。类天疱疮发生在口角因瘢痕粘连而致张口受限或小口畸形（C对），瘢痕性类天疱疮因此得名，腺周口疮愈合后也可形成瘢痕或组织缺损。寻常型天疱疮（A错）、大疱性类天疱疮（B错）、多形性类天疱疮（D错）愈合后会均不会形成瘢痕。